腮腺区低分化黏液表皮样癌的治疗不宜
A. 面神经保留不能勉强
B. 一般不作颈淋巴清扫术
C. 术后辅助放疗
D. 疑有血行转移可辅以化疗
E. 涉及下颌骨时，应行下颌骨部分切除

正确答案：B。一般不作颈淋巴清扫术

解析：本题考查低分化黏液表皮样癌的治疗。黏液表皮样癌根据黏液细胞的比例、细胞的分化、有丝分裂象的多少，以及肿瘤的生长方式，分为高分化或低分化两类，分化程度不同，肿瘤的生物学行为及预后大不一样，相应的治疗也不同。低分化黏液表皮样癌淋巴结的转移率较高，考虑进行选择性颈淋巴清扫术（B错，为本题的正确答案），且可出现血行性转移，术后易于复发，预后较差，属高度恶性肿瘤。病变发展较快，可有疼痛，边界不清，与周围组织黏连，常累及面神经，若面神经亦有病变时，面神经保留不能勉强（A对）。治疗以手术为主，低分化者宜加用术后辅助放疗（C对），疑有血行转移可辅以化疗（D对）。当病变涉及下颌骨时，应行下颌骨部分切除（E对）。